下面哪个机构负责为自愿接受艾滋病咨询、检测的人员免费提供咨询和初筛检测
A. 卫生行政主管部门
B. 医疗卫生机构
C. 疾病预防控制机构
D. 出入境检验检疫机构
E. 艾滋病监测机构

正确答案：B。医疗卫生机构

解析：县级以上地方人民政府卫生主管部门指定的医疗卫生机构，应当按照国务院卫生主管部门会同国务院其他有关部门制定的艾滋病自愿咨询和检测办法，为自愿接受艾滋病咨询、检测的人员免费提供咨询和初筛检测。掌握“艾滋病的预防与控制、治疗与法律责任”知识点。